3个月的婴儿应接种过疫苗中，可不包括
A. 卡介苗
B. 脊髓灰质炎三型混合疫苗
C. 百白破混合制剂
D. 乙肝疫苗
E. 麻疹疫苗

正确答案：E。麻疹疫苗

解析：掌握“儿童保健原则”知识点。